艾滋病患者最常见的机会感染是
A. 隐球菌脑膜炎
B. 带状疱疹
C. 念珠菌肺炎
D. 肺孢子菌肺炎
E. 巨细胞病毒食管炎

正确答案：D。肺孢子菌肺炎

解析：艾滋病患者常见的机会感染有：肺孢子菌肺炎、隐球菌脑膜炎、巨细胞病毒食管炎、带状疱疹等，其中最常见的是肺孢子菌肺炎（D对）。